属于抗代谢的抗肿瘤药是
A. 多柔比星
B. 拓扑替康
C. 甲氨蝶呤
D. 雷帕霉素
E. 奥沙利铂

正确答案：C。甲氨蝶呤

解析：本题考查抗肿瘤药。属于抗代谢的抗肿瘤药是甲氨蝶呤（C对）。影响核酸生物合成的药物又称抗代谢药，包括：1.二氢叶酸还原酶抑制剂：甲氨蝶呤、培美曲塞二钠等。2.胸苷酸合成酶抑制剂：氟尿嘧啶、卡培他滨等。3.DNA聚合酶抑制剂：吉西他滨、氟达拉滨等。多柔比星（A错）属蒽环类抗肿瘤抗生素。拓扑替康（B错）属喜树碱类抗肿瘤药。雷帕霉素（D错）是一种新型的大环内酯类免疫抑制剂。奥沙利铂（E错）为铂类化合物。